关于乙型肝炎病毒特征叙述错误的是
A. 电镜下可见3种颗粒形态
B. 完整病毒称为Dane颗粒
C. 对理化因素抵抗力很强
D. 主要经血液或注射传播
E. 有包膜RNA病毒

正确答案：E。有包膜RNA病毒

解析：乙型肝炎病毒是指引起人类急、慢性肝炎的DNA病毒，也称丹氏颗粒，简称HBV。掌握“乙型肝炎病毒”知识点。